具有活血止痛，行气解郁，凉血清心，利胆退黄功效的药物是
A. 虎杖
B. 牛膝
C. 郁金
D. 大黄
E. 栀子

正确答案：C。郁金

解析：郁金性味辛苦寒，归肝、胆、心、肺经，其功效为活血止痛，行气解郁，清心凉血，利胆退黄（C对）。虎杖的功效为利湿退黄，清热解毒，散瘀止痛，化痰止咳（A错）。牛膝的功效为逐瘀通经，补肝肾，强筋骨，利尿通淋，引血下行（B错）。大黄的功效为泻下攻积，清热泻火，凉血解毒，止血，逐瘀通经，利湿退黄（D错）。栀子的功效为泻火除烦，清热利湿，凉血解毒；外用消肿止痛（E错）。